将脂质吸附在极细的水溶性载体如氯化钠、山梨醇等表面制成的脂质体是
A. 热敏脂质体
B. 前体脂质体
C. 免疫脂质体
D. pH敏感脂质体
E. 长循环脂质体

正确答案：B。前体脂质体

解析：本题考查新型靶向脂质体。将脂质吸附在极细的水溶性载体如氯化钠、山梨醇等聚合糖类（增加脂质分散面积）制成前体脂质体（B对）。